正态分布的特点有
A. 算术均数=几何均数
B. 算术均数=中位数
C. 几何均数=中位数
D. 算术均数=几何均数=中位数
E. 以上都没有

正确答案：B。算术均数=中位数

解析：本题考查正态分布特点的相关内容。正态分布曲线形状为单峰、钟形，以直线x=µ, 为对称轴，X>µ,与X<µ, 范围内曲线下面积相等，各占50%，因此算数均数=中位数（B对ACDE错）。